目前临床常用的戒烟药物包括
A. 去甲替林
B. 可乐定
C. 阿司匹林
D. 肾上腺素
E. 尼古丁贴片

正确答案：E。尼古丁贴片

解析：尼古丁替代疗法类药物是常用的戒烟药物，现有剂型包括咀嚼胶、贴片、吸入剂、喷雾剂、含片等，因此，尼古丁贴片是目前临床常用的戒烟药物（E对）。